瓜蒂散的组成是
A. 瓜蒂、赤小豆
B. 瓜蒂、生姜
C. 瓜蒂、小茴香
D. 瓜蒂、藜芦
E. 瓜蒂、食盐

正确答案：A。瓜蒂、赤小豆

解析：瓜蒂散组成为瓜蒂、赤小豆（瓜蒂散中赤小豆，豆豉汁调酸苦凑，逐邪涌吐功最捷，脘痞痰食服之瘳）（A对）。